女，32岁，发现血脂升高3年，其父亲和哥哥均患有高胆固醇血症，查体双侧内眦黄色瘤，实验室检查：血清胆固醇7.5mmol/L，血清甘油三酯1.7mmol/L，血清低密度脂蛋白胆固醇5.1mmol/L，以下诊断正确的是
A. 继发性高甘油三酯血症
B. 原发性混合型高脂血症
C. 继发性高胆固醇血症
D. 家族性高甘油三酯血症
E. 家族性高胆固醇血症

正确答案：E。家族性高胆固醇血症

解析：血清血脂升高标准：甘油三酯≥2.3mmol/L（本例1.7mmol/L）， 总胆固醇≥6.2mmol/L（本例7.5mmol/L），低密度脂蛋白≥4.1mmol/L（本例5.1mmol/L），为高胆固醇血症（ABD错）。原发性血脂异由基因缺陷所致的血脂异常多具有家族聚集性（父亲和哥哥均具有高胆固醇血症），通常称为家族性高脂血症（E对C错）。